治疗无牙颌骨牙槽嵴严重吸收、萎缩的方法是
A. 系带矫正术
B. 牙槽嵴重建术
C. 前庭沟加深术
D. 消除有碍的骨突
E. 骨性隆突修整术

正确答案：B。牙槽嵴重建术

解析：本题考查牙槽嵴重建术的适应症。治疗无牙颌骨牙槽嵴严重吸收、萎缩的方法是牙槽嵴重建术（B对）。系带矫正术（A错）用于唇、舌系带接近牙槽嵴顶或舌系带过短，影响义齿的固位和功能活动时。前庭沟加深术（C错）用于牙槽嵴过度吸收致使义齿的固位差时。消除有碍的骨突（D错）用于牙齿拔除后由于骨质的吸收不均形成的骨尖或骨突，经过一段时间后仍不消退，导致义齿压痛，或有明显倒凹，妨碍义齿摘戴时。骨性隆突修整术（E错）用于过大的骨隆突在义齿摘戴时引起组织破溃疼痛，严重者义齿无法戴入使用时。